男，63岁。晨起发现言语不清，右侧肢体活动不适，既往体健。发病后5小时体检神志清楚，血压120/80mmHg，右中枢性面瘫，舌瘫，右侧上下肢体肌力2级，右半身痛觉减退。头颅CT未见异常。应选择的治疗方法是
A. 调整血压
B. 溶栓治疗
C. 应用止血剂
D. 手术治疗
E. 脑保护剂

正确答案：B。溶栓治疗

解析：患者初步诊断为左侧大脑中动脉脑血栓形成。脑血栓形成的治疗分为一般治疗和特殊治疗。一般治疗以维持生命体征、处理并发症等对症治疗为主。特殊治疗早期首选溶栓治疗，本例患者属于脑血栓形成早期，故首选溶栓治疗（B对）以挽救缺血半暗带。未行溶栓治疗的在48小时内抗血小板治疗。脑保护剂（E错）目前临床疗效并不确切。手术治疗（D错）只在患者出现危及生命的严重脑水肿、脑疝等症状时才使用（P183）。在发病24小时内，为改善脑组织的灌注，维持较高血压是必要的，只有在收缩压＞200mmHg或舒张压＞110mmHg时，才需要降低血压，本例患者血压120/80mmHg，不需调整血压（A错）。应用止血剂（C错）只有当患者出现上消化道出血表现时才需使用。